排毒系数考虑了污染物的
A. 排放量
B. 慢性毒作用阈浓度
C. 排放标准
D. 排放量和慢性毒作用阈浓度
E. 排放量和排放标准

正确答案：D。排放量和慢性毒作用阈浓度

解析：本题考查排毒系数需要考虑的污染物内容。排毒系数是表示某种污染物的排放量及其毒性对人群健康慢性危害程度的相对指标。它考虑了污染物的排放量和慢性毒作用阈浓度（D对ABCE错）。